急性阑尾炎手术后尿潴留，下列处理措施首选
A. 耻骨上膀胱穿刺
B. 无菌导尿后拔除尿管
C. 辅助起床，试行自行排尿
D. 应用利尿剂
E. 留置导尿4~5天

正确答案：C。辅助起床，试行自行排尿

解析：尿潴留指膀胱内充满尿液而不能排出。急性尿潴留的治疗原则是解除病因，恢复排尿。其最常用的处理方法是导尿术，急性阑尾炎术后患者下腹部切口疼痛以及病人不习惯卧床排尿等因素均可引起尿潴留，患者膀胱尿道无神经、器质性及梗阻等病变，此时，应辅助病人起床，试行自行排尿，尽早下床行动，如若不成功，再行置管导尿，且 注意缩短导尿管留置时间，以防医源性尿道感染。尿潴留属下尿道梗阻症状，应用利尿剂（D错）不但不会缓解病情，反而会加重急性尿潴留。耻骨上膀胱穿刺（A错）临床上既可以以此留取最可靠标本尿：多用于新生儿及截瘫病人，又可以治疗不能插入导尿管的急性尿潴留病人。